男，45岁。右腿车轮碾压伤2小时。查体：T37.2°C，P145次/分，R28次/分，BP85/55mmHg。神情淡漠，面色苍白，口唇干燥。两肺呼吸音清。腹软，无压痛。右小腿中部开放性外伤，伤口近端在院外己用止血带缚扎30分钟，伤口无明显渗血。足背动脉搏动弱。此时该患者处理措施错误的是
A. 中心静脉置管
B. 做好术前准备，急诊手术
C. 备血
D. 放开止血带，以免远端肢体缺血
E. 补充血容量

正确答案：D。放开止血带，以免远端肢体缺血

解析：患者右腿车轮碾压伤，T37.2°C（轻度升高，正常36°C-37°C），P145次/分（加快，正常60-100次/分），R28次/分（加快，正常12-20次/分），BP85/55mmHg（低，正常﹥90/60mmHg，提示血容量不足）。神情淡漠，面色苍白，口唇干燥。右小腿中部开放性外伤，伤口近端在院外己用止血带缚扎30分钟（止血带应每隔1小时放松1-2分钟）（D错，为本题正确答案），伤口无明显渗血。足背动脉搏动弱。中心静脉置管（A对）、备血（C对）、补充血容量（E对）均为进一步救治措施，做好术前准备，急诊手术（B对）为急症措施。